胃大部切除术后出现贫血主要是由于减少了
A. 主细胞
B. 壁细胞
C. 粘液细胞
D. G细胞
E. 嗜银细胞

正确答案：B。壁细胞

解析：胃大部切除术后胃酸减少，壁细胞（B对）减少，导致内因子生成不足，使得铁与维生素B12吸收障碍，可引起贫血；主细胞（A错）主要分泌胃蛋白酶原，与术后出现贫血无关；粘液细胞（C错）主要分泌粘液覆盖在胃壁内层保护胃黏膜不受盐酸侵蚀，与术后出现贫血无关；G细胞（D错）分泌的主要是胃泌素，主要刺激胃酸和胃蛋白酶原的分泌；刺激，ECL细胞分泌组胺，间接促进壁细胞分泌胃酸；促进消化道黏膜的生长和刺激胃、肠、胰的蛋白质合成， 即营养作用；加强胃肠运动和胆囊收缩，促进胰液、胆汁的分泌。术后出现贫血无关；嗜银细胞（E错）广泛存在于消化道，对消化系统内的各种激素分泌的调节具有重要作用，不会引起术后贫血症状。